病例对照研究之所以需要对照是因为
A. 某些研究因素在两组可比
B. 可追踪观察以确定是否发生所研究的疾病
C. 可增加样本量，以达到统计学要求
D. 可以比较病例组与对照组某因素暴露率的差别，从而有助于进一步研究
E. 以对照组的暴露作为人群暴露的估计

正确答案：D。可以比较病例组与对照组某因素暴露率的差别，从而有助于进一步研究